对于溺水儿童采取急救措施主要是使儿童
A. 立即恢复呼吸道通畅及复苏心肺功能
B. 呼吸新鲜空气
C. 活动四肢
D. 立即保暖
E. 心肺复苏

正确答案：A。立即恢复呼吸道通畅及复苏心肺功能

解析：本题考查儿童溺水的急救措施。儿童溺水的急救措施：①迅速清除口鼻污物，恢复呼吸道通畅；②采用口对口人工呼吸方法，并配合胸外心脏按压术进行心肺复苏；③就地复苏后应立即送医院作进一步抢救和治疗，转院的途中要密切观察病情并注意保暖。其中最主要的是就地抢救，使儿童立即恢复呼吸道通畅及复苏心脏搏动（A对BCDE错）。